一次性使用无菌注射器，其注射器部分有关“生物性能”的质量要求是
A. 无菌、无芽孢、无病毒
B. 无热原、无芽孢、无病毒
C. 无菌、无热原、无病毒
D. 无菌、无热原、无溶血反应、无生物活性异物
E. 无菌、无热原、无溶血反应、无急性全身毒性

正确答案：E。无菌、无热原、无溶血反应、无急性全身毒性